破伤风梭菌属于
A. 专性需氧菌
B. 专性厌氧菌
C. 兼性厌氧菌
D. 微需氧菌
E. 微需二氧化碳

正确答案：B。专性厌氧菌

解析：破伤风梭菌为专性厌氧菌，最适生长温度为37℃，pH7.0～7.5，营养要求不高，在普通琼脂平板上培养24～48小时后，可形成直径1mm以上不规则的菌落，中心紧密，周边疏松，似羽毛状菌落，易在培养基表面迁徙扩散。掌握“厌氧芽胞梭菌”知识点。